芬太尼的临床应用是
A. 剧烈疼痛
B. 帕金森病
C. 癫痫小发作
D. 精神分裂症
E. 风湿性关节炎

正确答案：A。剧烈疼痛

解析：本题考查芬太尼。芬太尼属短效、强效镇痛药，临床主要用于手术前、中、后及术中等各种剧烈疼痛（A对）；帕金森病（B错）治疗药物种类多样，包括抗胆碱能药、多巴胺受体激动剂、单胺氧化酶抑制剂、COMT抑制剂等；癫痫小发作（C错）首选药为乙琥胺和丙戊酸钠；精神分裂症（D错）可用抗精神分裂药物，如氯丙嗪；风湿性关节炎（E错）可用非甾体抗炎药如阿司匹林、吲哚美辛。